胸骨左缘第二肋间闻及收缩期杂音，最常见的器质性病变是
A. 二尖瓣关闭不全
B. 二尖瓣狭窄
C. 房间隔缺损
D. 主动脉瓣关闭不全
E. 室间隔缺损

正确答案：C。房间隔缺损

解析：房间隔缺损（C对）时，左房向右房分流，右房血液增加，右室血液也相应增加，肺动脉瓣相对狭窄，出现胸骨左缘第二肋间收缩期杂音。二尖瓣关闭不全（A错）可闻及心尖部收缩期杂音。二尖瓣狭窄（B错）时，心尖部可有典型舒张期隆隆样杂音。主动脉瓣关闭不全（D错）可在主动脉瓣第二听诊区（胸骨左缘第3肋间）舒张期闻及粗糙响亮射流样杂音。室间隔缺损（E错）典型体征为胸骨左缘3、4肋间有粗糙收缩期杂音。